医疗机构擅自从事精神障碍诊断、治疗的法律责任说法有误的是
A. 不符合本法规定条件的医疗机构擅自从事精神障碍诊断、治疗的，由县级以上人民政府卫生行政部门责令停止相关诊疗活动
B. 不符合本法规定条件的医疗机构擅自从事精神障碍诊断、治疗的，由县级以上人民政府卫生行政部门给予警告，并处五千元以上一万元以下罚款
C. 不符合本法规定条件的医疗机构擅自从事精神障碍诊断、治疗，有违法所得的没收违法所得
D. 对直接负责的主管人员和其他直接责任人员依法给予或者责令给子降低岗位等级或者吊销其执业证书
E. 对有关医务人员，吊销其执业证书

正确答案：D。对直接负责的主管人员和其他直接责任人员依法给予或者责令给子降低岗位等级或者吊销其执业证书